药物被吸收进入血液循环的速度与程度称为
A. 生物转化
B. 生物利用度
C. 生物半衰期
D. 肠肝循环
E. 表观分布容积

正确答案：B。生物利用度

解析：本题考查生物利用度。生物利用度（B对）是指药物被吸收进入血液循环的速度与程度；生物转化（A错）是指外源化学物在机体内经多种酶催化的代谢转化；药物的半衰期（C错）指体内药物的量降低一半所需的时间；肠肝循环（D错）指经胆汁或部分经胆汁排入肠道的药物，在肠道中又重新被吸收，经门静脉又返回肝脏的现象；表观分布容积（E错）是指当药物在体内达动态平衡后，体内药量与血药浓度之比值。